下列哪项提示左心功能不全
A. 脉搏强而大
B. 舒张早期奔马律
C. 奇脉
D. 脉搏过缓
E. 脉搏绝对不齐

正确答案：B。舒张早期奔马律

解析：左心功能不全的心脏体征有心脏扩大、相对性二尖瓣关闭不全的反流性杂音、肺动脉瓣区第二心音亢进及舒张期奔马律（B对）。脉搏强而大（A错）见于各种原因引起的高热患者。奇脉（C错）见于心包积液和缩窄性心包炎。脉搏过缓（D错）常见于颅内压增高、房室传导阻滞、洋地黄中毒等。脉搏绝对不齐（E错）见于心房颤动的患者。